在咬肌前缘可触及其搏动的血管是
A. 舌动脉
B. 面动脉
C. 上颌动脉
D. 颞浅动脉
E. 颈内动脉

正确答案：B。面动脉

解析：面动脉（B对）在咬肌前缘可触及其搏动，当面部出血时可在此处进行压迫止血。